垂体
A. 成对
B. 借漏斗连于下丘脑
C. 位于颅前窝内
D. 仅由神经组织组成
E. 不产生激素

正确答案：B。借漏斗连于下丘脑

解析：垂体为一（A错）灰红色的椭圆形小体，位于颅底蝶鞍的垂体窝内（C错），垂体分为腺垂体和神经垂体两部分（D错），其中腺垂体的远侧部和结节部又合称为垂体前叶，能分泌生长激素、促甲状腺激素、促肾上腺皮质激素、促性腺激素（E错）。神经垂体分为神经部和漏斗两部分，借漏斗连于下丘脑（B对），包括漏斗柄和正中隆起。